躯干、四肢痛温觉第二级神经元的胞体位于
A. 脊神经节
B. 胸核
C. 腹后外侧核
D. 下橄榄核
E. 后角固有核

正确答案：E。后角固有核

解析：躯干和四肢意识性本体感觉和精细触觉传导通路，该传导路由3级神经元组成：第1级神经元为脊神经节内假单极神经元（A错）。第2级神经元胞体位于后角固有核（E对），最后终止于背侧丘脑腹后外侧核（C错）。第3 级神经元最后经内囊后肢投射到中央后回中、上部和中央旁小叶后部。